新药临床评价中Ⅱ期临床试验的对象主要病种试验例数至少选用
A. 30例
B. 200例
C. 100例
D. 1000例
E. 2000例

正确答案：C。100例

解析：本题考查新药临床评价的分期。Ⅱ期临床试验的试验对象为目标适应证患者，试验样本数多发病不少于300例，其中主要病种不少于100例（C对）。I期临床试验的试验样本数一般为20～30例（A错）。Ⅲ期试验样本数不得少于Ⅱ期。Ⅳ期临床试验样本数常见病不少于2000例（E错）。